所谓“管间侧支”是指
A. 相邻根管间的交通支
B. 根管的细小分支
C. 垂直于主根管的分支
D. 主根管分支贯穿牙本质和牙骨质达牙周膜
E. 根管在根尖部分歧

正确答案：A。相邻根管间的交通支

解析：本题考查管间吻合。管间侧支，又称管间吻合或管间交通支，为发自相邻根管间的交通支（A对），多见于双根管，根中1/3的管间侧支多于根尖1/3，根颈1/3最少；根管的细小分支称为根管侧支（B错），常与主根管接近垂直，呈垂直于主根管的分支（C错），贯穿牙本质和牙骨质达牙周膜（D错）；根管在根尖部分歧（E错）称为根尖分歧。